痛觉和温度觉传导通路的第二级神经元是
A. 丘脑腹外侧核
B. 脊髓后角细胞
C. 延髓薄束核与楔束核
D. 脊髓前角细胞
E. 后根神经节

正确答案：B。脊髓后角细胞

解析：躯体感觉包括深感觉和浅感觉：浅感觉又包括触-压觉、温度觉和痛觉，浅感觉的传入纤维进入脊髓后在后角换元，第二级神经元发出纤维经白质前连合交叉至对侧，在脊髓前外侧部上行，形成前外侧索传入系统，因此痛觉和温度觉传导通路的第二级神经元是后角（B对）；深感觉即为本体感觉，主要包括位置觉和运动觉，深感觉的传入纤维进入脊髓后沿后索上行，在延髓下部的薄束核和楔束核（C错）更换神经元（简称换元），换元后的第二级神经元发出纤维交叉至对侧组成内侧丘系后者抵达丘脑的特异感觉接替核后外侧腹核，此处存在第三级神经元。